因中气下陷所致的久痢脱肛及子宫下垂，都可采用升提中气法治疗，此属于
A. 因人制宜
B. 同病异治
C. 异病同治
D. 审因论治
E. 虚则补之

正确答案：C。异病同治

解析：子宫下垂、久痢脱肛等病变，其病机的关键是“中气下陷”，可表现为大致相同的证，故皆可用补益中气的方法来治疗。几种不同的疾病，在其发展变化过程中出现了大致相同的病机，表现为大致相同的证，因而采用大致相同的治法和方药来治疗，称为“异病同治”（C对）。中医学对疾病治疗的着眼点是证，即所谓“证同治亦同，证异治亦异”，这是辨证论治的精神实质。